香砂平胃颗粒的功能是
A. 温中补虚
B. 温中益气
C. 理气化湿
D. 清胃理气
E. 温中和胃

正确答案：C。理气化湿

解析：本题考查香砂平胃颗粒的功能。香砂平胃颗粒的功能是理气化湿（C对）。香砂平胃丸（颗粒）【功能】理气化湿，和胃止痛。小建中合剂【功能】温中补虚（A错），缓急止痛。香砂养胃颗粒（丸）【功能】温中和胃（E错）。